化学药品说明书中不可缺少的项目标题有
A. 药物相互作用
B. 儿童用药
C. 老年患者用药
D. 孕妇及哺乳期妇女用药
E. 药物过量

正确答案：A、D。药物相互作用；孕妇及哺乳期妇女用药